下列说法中哪项描述符合嵌体的禁忌证
A. 邻接不良
B. 食物嵌塞严重
C. 已涉及边缘嵴以及面
D. 较大体积的健康牙体组织
E. 前牙邻、唇面缺损未涉及切角者

正确答案：E。前牙邻、唇面缺损未涉及切角者

解析：嵌体禁忌证：①青少年的恒牙和儿童的乳牙，因其髓角位置高不宜作嵌体，以免损伤牙髓；②（牙合）面缺损范围小而且表浅，前牙邻、唇面缺损未涉及切角者，不宜用嵌体修复；③牙体缺损范围大，残留牙体组织抗力形差，固位不良者；④磨耗重，不能预备出足够箱状洞形深度而影响固位或导致牙本质过敏者；⑤根管治疗后的无髓牙牙体组织抗折性能差，不适合嵌体修复。掌握“牙体缺损修复体固位及适应、禁忌证”知识点。